《执业医师法》规定管理本行政区域医师工作机构是
A. 县级以上人民政府劳动人事部门
B. 县级以上人民政府工商行政部门
C. 县级以上人民政府卫生行政部门
D. 医师协会
E. 县级以上人民政府

正确答案：C。县级以上人民政府卫生行政部门

解析：《执业医师法》规定，县级以上人民政府卫生行政部门（C对）是医师执业的主管部门，负责本行政区域内的医师执业监督管理工作。